导致脉压增大的疾病是
A. 主动脉瓣狭窄
B. 心力衰竭
C. 低血压
D. 主动脉瓣关闭不全
E. 缩窄性心包炎

正确答案：D。主动脉瓣关闭不全

解析：脉压明显增大常见于有效循环血量、心输出量增加等情况，如主动脉瓣关闭不全（D对）、甲状腺功能亢进、动脉硬化等。主动脉瓣关闭不全时，舒张期，主动脉内的血液经过关闭不全的主动脉瓣回流至左心室，致左心室内血液增加，主动脉内血液减少，舒张压下降；收缩期时，由于左心室的血量增加，射入主动脉的血液量增加，收缩压上升，故脉压增大。脉压减小则多见于有效循环血量减少、心脏舒张功能不全、心室充盈受限和输出道梗阻等情况，如主动脉瓣狭窄（A错）、心包积液、严重心力衰竭（B错）、低血压（C错）及缩窄性心包炎（E错）等。